牙根不能继续发育的年轻恒牙经治疗后根尖封闭是否完全取决于
A. 根尖部残髓的情况
B. 根尖周组织健康情况
C. 氢氧化钙的作用
D. 根管内炎症的控制
E. 以上均是

正确答案：E。以上均是

解析：本题考查影响根尖封闭的因素。年轻恒牙的牙髓和根尖周病变不能用常规的根管治疗，应首先使根尖闭锁，可通过根尖钙化屏障和根尖诱导成形术使牙根继续发育，根尖孔形成根尖闭锁。诱导根尖所依赖的组织有根尖部残留的生活牙髓（A对）、根尖部的牙乳头、根尖周组织（B对）的上皮根鞘，待炎症消退后，上皮根鞘才能诱导牙乳头分化为成牙本质细胞继续形成根尖部牙本质，诱导根尖周组织分化为成牙骨质细胞形成根尖部牙骨质。氢氧化钙诱导剂（C对）的作用是控制根管内的感染（D对）、消除包括牙乳头、残留根尖端牙髓、根尖周组织炎症，恢复并促进它们的修复功能，从而使根尖继续发育达到根尖闭锁的目的。（ABCD均对，故E为本题的正确答案）。